眼神经出颅经
A. 圆孔
B. 棘孔
C. 卵圆孔
D. 眶上裂
E. 面神经管

正确答案：D。眶上裂

解析：眼神经为感觉神经，经眶上裂出颅，主要分布于泪腺、眼球、眼睑、前额皮肤和部分鼻黏膜。掌握“三叉神经的分支与分布”知识点。